26岁初产妇，临产后出现下腹剧痛，烦躁不安，呼叫，下腹拒按，最可能的诊断应是
A. 前置胎盘
B. 羊水过多
C. 胎盘早剥
D. 先兆子宫破裂
E. 子宫破裂

正确答案：D。先兆子宫破裂

解析：青年初产妇，临产后下腹剧痛，烦躁不安，呼叫，下腹拒按（先兆子宫破裂的产妇会出现烦躁不安，呼吸、心率加快，下腹剧痛难忍的表现），故最可能的诊断为先兆子宫破裂（D对）。前置胎盘（P127）（A错）典型症状为妊娠晚期或临产时，发生无诱因、无痛性反复阴道流血。羊水过多（P136）（B错）多发生在20～24周，表现为一系列压迫症状，如行动不便，因横隔抬高，出现呼吸困难，甚至发绀，不能平卧等。胎盘早剥（P131）（C错）多见于有重度妊娠高血压综合征等高危因素的患者，表现为腹痛伴或不伴阴道流血，常伴休克症状。子宫破裂（P218）（E错）分为不完全性子宫破裂和完全性子宫破裂，不完全性子宫破裂多见于子宫下段剖宫产切口瘢痕破裂，常缺乏先兆子宫破裂症状，仅在不全破裂处有压痛，体征不明显；完全性子宫破裂继先兆子宫破裂症状后，产妇突感下腹一阵撕裂样剧痛，子宫收缩骤然停止，后伴有低血压休克症状，胎心胎动消失。